肿瘤化疗的主要副反应是
A. 口腔溃疡
B. 胃肠道反应
C. 骨髓抑制
D. 脱发
E. 肝损害

正确答案：C。骨髓抑制

解析：本题考查肿瘤化疗的主要副反应。化疗是治疗肿瘤的一种方法，其主要的不良反应是骨髓抑制（C对）。大多数化疗药均可引起有不同程度的骨髓抑制,使周围血细胞数量减少,血细胞由多种成分组成,每一种成分都对人体起着不可缺少的作用，严重减少者可危及生命，故骨髓抑制是肿瘤化疗的主要副反应。此外，肿瘤化疗的不良反应还有口腔溃疡（A错），可用抗生素、激素、麻油混合液局部涂布，不属于肿瘤化疗的主要副作用。胃肠道反应（B错），多表现为食欲减退、恶心、呕吐、腹泻或腹痛等症状，停药后可逐渐恢复，故胃肠道反应不是主要副作用。脱发（D错）不会对身体产生明显副作用。肿瘤化疗会有肝损害（E错）的副作用，但在治疗过程中注意保肝、护肝，不会对肝产生明显危害。